最能反映医患关系性质的是医务人员与患者之间的
A. 信托关系
B. 陌生人之间的关系
C. 主动-被动关系
D. 类似父（母）子间的关系
E. 商品关系

正确答案：A。信托关系

解析：医患信托关系是医务人员和医疗机构受患者的信任和委托，保障患者在医疗活动中的健康利益不受损害并有所促进的一种关系。医患关系不同于一般的法律合同关系、单纯的契约关系，它要以医患间的真诚信任为基础，而不是完全依靠法律的外在约束。但是在市场经济条件下，也揭示了医患关系的信托性质，说明忽视或背离信托性质的医患关系只能是一种矛盾的、不和谐的关系。掌握“医患关系伦理”知识点。